缩泉丸处方的臣药是
A. 山药
B. 菟丝子
C. 乌药
D. 补骨脂
E. 盐益智仁

正确答案：C。乌药

解析：本题考查的是缩泉丸的方义简释。缩泉丸处方的臣药是乌药（C对）。缩泉丸：【药物组成】益智仁（盐炒）、乌药、山药（BD错）。【方义简释】方中益智仁（E错）辛温香燥，温补固涩，盐炒后辛燥之性减缓而温涩之能却增，善温肾阳、缩小便，治肾气虚寒之遗尿、尿频，故为君药。乌药辛温香散，善温肾气，散膀胱冷气而助气化，以增君药的温肾缩尿之功，故为臣药。山药（A错）甘补兼涩，性平不偏，善益气养阴、固精缩尿，既助君臣药之力，又制其温燥，故为佐药。全方配伍，温固而不燥热，共奏温肾祛寒、缩尿止遗之功，故善治肾虚所致的小便频数、夜间遗尿。